腹腔镜胆囊切除优于开腹胆囊切除不包括
A. 住院时间短
B. 术后疼痛轻
C. 可早期恢复正常活动
D. 腹壁创伤的并发症少
E. 胆道损伤的风险性小

正确答案：E。胆道损伤的风险性小

解析：与传统的开腹胆囊切除术相比，腹腔镜胆囊切除术住院时间短（A对）、术后疼痛轻（B对）、可早期恢复正常活动（C对）、腹壁创伤的并发症少（D对）。但腹腔镜胆囊切除胆道损伤的风险性（E错）仍高于开腹胆囊切除。